下列哪种疾病与DNA修复过程缺陷有关
A. 痛风
B. 黄疽
C. 蚕豆病
D. 着色性干皮病
E. 卟啉病

正确答案：D。着色性干皮病